慢性唇炎的病因是
A. 舔唇不良习惯
B. 创伤
C. 感冒所致
D. 消化不良
E. 残根残冠刺激

正确答案：A。舔唇不良习惯

解析：本题考查慢性唇炎的病因。慢性唇炎又称慢性非特异性唇炎，病因不明,可能与温度、化学、机械性因素的长期持续性刺激有关，例如舔唇的不良习惯（A对）等。感冒（C错）易导致唇疱疹的出现，创伤（B错）、残根残冠刺激（E错）可能导致创伤性溃疡等疾病的出现，消化不良（D错）可导致口腔异味等，都不是慢性唇炎的病因。